卵巢分泌
A. GnRH
B. 促性腺激素
C. 性激素，包括雌激素、孕激素和少量雄激素
D. 绒毛膜促性腺激素
E. 糖皮质激素、盐皮质激素

正确答案：C。性激素，包括雌激素、孕激素和少量雄激素

解析：本题考查卵巢分泌的激素。卵巢分泌的激素主要有三类：雌激素、孕激素以及少量雄激素（C对ABDE错），会有不同作用，三种激素缺一不可。一般雌激素对于身体的成长发育较为重要，对促进第二性征发育有一定的作用。孕激素可以在月经期保持体温稳定，抑制排卵，在孕期能够帮助维持胎儿稳定。而少量的雄激素一般主要作用于人体器官发育，同时可以维持女性正常生殖功能。